患者，女，45岁，曾外伤，牙龈萎缩，右上颌12缺失，其余牙健康。患者要求美观，考虑年龄，医师可摘局部义齿修复。肯氏分类设计为
A. 第一类的第一亚类
B. 第二类
C. 第三类
D. 第四类
E. 第四类的第一亚类

正确答案：C。第三类

解析：本题考查局部义齿类型，肯氏分类及模型观测。第三类（C对）：缺隙位于牙弓一侧，缺隙前后均有余留牙，即单侧非游离缺失。